用药期间禁止饮酒否则可出现面部潮红、头痛、眩晕等“双硫仑反应”的药品是
A. 青霉素钾
B. 克林霉素
C. 庆大霉素
D. 头孢哌硐
E. 依替米星

正确答案：D。头孢哌硐

解析：本题考查服用药品的特殊提示。头孢哌酮（D对）在体内可抑制乙醛脱氢酶，使乙醇在体内转化成乙醛后不能排出，出现“双硫仑样反应”。青霉素钾（A错）、克林霉素（B错）、庆大霉素（C错）和依替米星（E错）在体内不抑制乙醛脱氢酶，服药期间饮酒均不会出现“双硫仑反应”。